以下反应所鉴别的药物是，三氯化铁试液反应
A. 葡萄糖
B. 磺胺嘧啶
C. 硫酸阿托品
D. 奥沙西泮
E. 丙磺舒

正确答案：E。丙磺舒